小儿咽扁颗粒的功能是
A. 清热滋阴，祛痰利咽
B. 清热解毒，敛疮止痛
C. 清热利咽，解毒止痛
D. 清热解毒，消肿利咽
E. 清热利咽，生津润燥

正确答案：C。清热利咽，解毒止痛

解析：本题考查的是小儿咽扁颗粒的功能。小儿咽扁颗粒的功能是清热利咽，解毒止痛（C对）。小儿咽扁颗粒：【功能】清热利咽，解毒止痛。玄麦甘桔含片：【功能】清热滋阴，祛痰利咽（A错）。六神丸：【功能】清热解毒，消肿利咽（D错），化腐止痛。清音丸：【功能】清热利咽，生津润燥（E错）。功能为清热解毒，敛疮止痛（B错）的中成药，2022年考试指南未明确说明。